肩髃穴归属的经脉是
A. 手阳明大肠经
B. 手太阳肺经
C. 手太阳小肠经
D. 手少阳三焦经
E. 手厥阴心包经

正确答案：A。手阳明大肠经

解析：肩髃穴归属手阳明大肠经(A对)。